苯海索治疗帕金森病的作用机制是
A. 中枢抗胆碱作用
B. 激活多巴胺受体
C. 减少多巴胺降解
D. 抑制多巴胺再摄取
E. 提高脑内多巴胺浓度

正确答案：A。中枢抗胆碱作用

解析：可通过拮抗胆碱受体而减弱黑质-纹状体通路中ACh的作用，抗震颤效果好，也能改善运动障碍和肌肉强直；对少数不能接受L-DOPA或多巴胺受体激动药的PD病人，可用本药治疗。掌握“左旋多巴、卡比多巴、苯海索”知识点。